某乡5000户约2万人，欲抽其1/5人口进行某病调查，随机抽取1户开始后，每隔5户抽取1户，抽到的户其每个成员均进行调查，这种抽样方法为
A. 分层抽样
B. 系统抽样
C. 整群抽样
D. 简单抽样

正确答案：B。系统抽样

解析：本题考查系统抽样的概念。系统抽样（B对ACD错）又称机械抽样，是按照一定顺序，机械地每隔若干单位抽取一个单位的抽样方法。具体抽样方法如下：设总体单位数为N，需要调查的样本数为n，则抽样比为n/N，抽样间隔为K＝N/n。每K个单位为一组，然后用单纯随机方法在第一组中确定一个起始号，从此起始点开始，每隔K个单位抽取一个作为研究对象。该题目中的抽样方法符合系统抽样的方法。